口服药物被肠壁和肝脏代谢后进入体循环的药量明显减少的现象称为
A. 重吸收
B. 首过消除
C. 首剂效应
D. 生物转化
E. 肝肠循环

正确答案：B。首过消除

解析：口服药物被肠壁和肝脏代谢后进入体循环的药量明显减少的现象称为首过消除（B对）。生物转化（D错）是指药物吸收后在体内经酶或其他作用发生一系列的化学反应，导致药物化学结构上的转变（P9）。肠肝循环（E错）是指部分药物经肝脏转化形成极性较强的水溶性代谢产物，被分泌到胆汁内经由胆道及胆总管进入肠腔，然后随粪便排泄，经胆汁排入肠腔的药物部分可再经小肠上皮细胞吸收经肝脏进入血液循环，这种肝脏、胆汁、小肠间的循环称肠肝循环（P12）。